既往月经规律，妊娠42+5周，不能出现
A. 羊水增多
B. 羊水粪染
C. 胎儿生长受限
D. 胎儿过熟
E. 巨大胎儿

正确答案：A。羊水增多

解析：既往月经规律，妊娠42+5周，提示为过期妊娠，它的病理改变包括①胎盘：（1）胎盘功能正常；（2）胎盘功能减退。②羊水粪染（B对）；③正常生长及巨大儿（E对）；④胎儿过熟综合征（D对）；⑤胎儿生长受限（C对）；所以过期妊娠不可能羊水增多（A错，为本题正确答案）”。